男，38岁。因车祸致骨盆、股骨骨折急诊手术。术后1天逐渐出现憋气，烦躁不安。经皮血氧饱和度（SpO₂）监测示由98%逐渐下降至87%，经面罩给氧（5升/分）后SpO₂增加至89%，但症状缓解不明显。查体：T37.2℃，P103次/分，R32次/分，BP90/60mmHg，意识清楚，口唇发绀，双肺呼吸音对称，双肺闻及少许湿啰音。该患者最可能的诊断是
A. 气胸
B. 肺血栓栓塞
C. 腹腔内出血
D. 急性左心衰竭
E. 急性呼吸窘迫综合征

正确答案：E。急性呼吸窘迫综合征

解析：男性患者，有骨折急诊手术史（是急性呼吸窘迫综合征的常见危险因素），现逐渐出现憋气，烦躁不安，经皮血氧饱和度（SpO₂）监测示由98%逐渐下降至87%，经面罩给氧（5升/分）后SpO₂增加至89%，但症状缓解不明显，表明有顽固性低氧血症的症状（是急性呼吸窘迫综合征特征性症状），心肺查体未见明显异常，根据其临床表现和辅助检查，考虑诊断为急性呼吸窘迫综合征（E对）。气胸（P120）（A错）患者有突然发生的呼吸困难，伴有胸痛，肺部叩诊呈鼓音，呼吸音减弱或消失。肺血栓栓塞（P100）（B错）可表现为呼吸困难、胸痛、咯血三联征，呼吸系统体征以呼吸急促最常见，肺动脉瓣区第二心音亢进（P₂＞A₂）或分裂，三尖瓣区收缩期杂。腹腔内出血（C错）常有腹部创伤史，可有休克，但一般无肺部啰音及憋气的表现。急性左心衰（P174-P175）（D错）常表现为突发性呼吸困难，端坐位，咳粉红色泡沫痰，听诊时两肺布满湿性啰音和哮鸣音。